关于盐酸克林霉素性质的说法，正确的有
A. 口服吸收良好，不易被胃酸破坏
B. 化学稳定性好，对光稳定
C. 含有氮原子，又称氯洁霉素
D. 为林可霉素半合成衍生物
E. 可用于治疗金黄色葡萄球菌骨髓炎

正确答案：A、B、C、D、E。口服吸收良好，不易被胃酸破坏；化学稳定性好，对光稳定；含有氮原子，又称氯洁霉素；为林可霉素半合成衍生物；可用于治疗金黄色葡萄球菌骨髓炎

解析：本题考查盐酸克林霉素的性质。盐酸克林霉素口服吸收良好，不易被胃酸破坏（A对）。克林霉素C-7位R1被氯离子取代，对光稳定（B对）。含有氮原子，又称氯洁霉素（C对）。克林霉素（D对）是林可霉素的半合成衍生物，是治疗金黄色葡萄球菌引起的急慢性骨髓炎及关节感染的首选药（E对）。